十二指肠纵襞的位置多在
A. 十二指肠上部内侧
B. 十二指肠降部外侧
C. 十二指肠降部的后内侧
D. 十二指肠水平部内侧
E. 十二指肠升部内侧

正确答案：C。十二指肠降部的后内侧

解析：降部黏膜可形成发达的环状襞，十二指肠纵襞多在降部中份后内侧壁上(C对)。